典型的矽结节横断面似
A. 葱头状
B. 星芒状
C. 网状
D. 不规则状
E. 以上全对

正确答案：A。葱头状

解析：本题考查典型矽结节的切面形态。典型矽结节横断面以葱头状（A对BCDE错），在课本中，葱头状的横断面为一大常考考点，外周包裹的同心圆状的胶原纤维，也是选择题的常考考点。